女，30岁。孕40周，无剖宫产适应证，但产妇及家属坚决要求剖宫产。术后新生儿出现呼吸困难，诊断新生儿湿肺，家属对此提出质疑。主治医师称，产妇本不该手术，自然分娩该病发生的概率较低，这些信息已告知且产妇及家属已签字。但家属认为，医生是权威，应由医生决定是否进行手术，如果医生讲清楚剖宫产会导致新生儿湿肺，我们不会再坚持。本案例中，该医师违背的临床诊疗伦理要求是
A. 履行知情同意手续
B. 药品合理配伍
C. 未严格掌握手术适应症
D. 医护精诚协作
E. 认真做好术前准备

正确答案：C。未严格掌握手术适应症

解析：主治医师称，产妇无剖宫产适应证，本不该手术，自然分娩该病发生的概率较低，这些信息已告知且产妇及家属已签字（A错），但产妇及家属坚决要求剖宫产。术后新生儿出现呼吸困难，诊断新生儿湿肺。该医师违背的临床诊疗伦理要求是未严格掌握手术适应症（C对）。